有机磷酸酯类中毒的解救药有
A. 肾上腺素
B. 碘解磷定
C. 氯磷定
D. 毛果芸香碱（匹鲁卡品）
E. 阿托品

正确答案：B、C、E。碘解磷定；氯磷定；阿托品

解析：本题考查有机磷中毒解救。有机磷酸酯类中毒的解救药有解磷定（B对）、氯磷定（C对）、阿托品（E对）。解磷定、氯磷定、双复磷、双解磷为目前常用的有机磷农药中毒解救药。阿托品能拮抗乙酰胆碱的毒蕈碱样作用，提高机体对乙酰胆碱的难受性。肾上腺素（A错）常用于抢救过敏性休克，如青霉素引起的过敏性休克。毛果芸香碱（D错）为拟M胆碱药，有缩瞳、降低眼压、调节痉挛的作用，阿托品为M胆碱受体阻断药，阿托品应用过量时，应用拟胆碱药可以中和中毒症状。